休克时应用血管活性药物的主要目的是
A. 提高心脏前负荷
B. 增加心脏后负荷
C. 增加心肌收缩力
D. 提高组织的血液灌流量
E. 降低组织代谢

正确答案：D。提高组织的血液灌流量

解析：在休克时应用血管活性药物可以改善微循环，增加组织灌流量和回心血量。掌握“休克”知识点。